膈神经何者错误？
A. 在纵隔胸膜与心包之间下降
B. 其分支为副膈神经
C. 跨肺根前方下行
D. 支配膈肌司腹式呼吸
E. 有感觉纤维分布于胸膜、腹膜等处

正确答案：B。其分支为副膈神经

解析：膈神经入胸腔后有心包膈血管与其伴行，经由肺根前方（C对），在纵隔胸膜与心包之间下行到达膈肌（A对），其运动纤维支配膈肌的运动（D对），感觉纤维分布于胸膜、心包以及膈肌下面的部分腹膜（E对）。副膈神经为颈丛一不恒定分支（B错，为本题正确选项）。